上述反佐药含义的表述，正确的是
A. 针对主病或主证起主要治疗作用
B. 针对重要的兼病或兼证起主要治疗作用
C. 针对次要兼证起直接治疗作用
D. 消减或制约君、臣药的毒性和峻烈之性
E. 防止病重邪甚时药病格拒

正确答案：E。防止病重邪甚时药病格拒

解析：佐药：一是佐助药，即协助君、臣药以加强治疗作用，或直接治疗次要兼证的药物（C错）；二是佐制药，即制约君、臣药的峻烈之性，或减轻或消除君、臣药毒性的药物（D错）；三是反佐药，即根据某些病证之需，配伍少量与君药性味或作用相反而又能在治疗中起相成作用的药物，防止病重邪甚时药病格拒（E对）。针对主病或主证起主要治疗作用的药物（A错）是君药，是方中不可或缺，且药力居首的药物。臣药：一是辅助君药加强治疗主病或主证的药物；二是针对兼病或兼证起治疗作用的药物（B错），其在方中之药力小于君药。